患者眩晕，动则加剧，劳则即发，面色白，唇甲不华，心悸少寐，神疲懒言，饮食减少，舌质淡，脉细弱。其治法是
A. 健脾益气，益肾温中
B. 温补脾肾，通络宁心
C. 健脾益肾,活血化瘀
D. 补益肝肾，化瘀通络
E. 补养气血，健运脾胃

正确答案：E。补养气血，健运脾胃

解析：题中患者以眩晕为主症，故诊断为眩晕。气虚则清阳不展，血虚则脑失所养，故患者眩晕，动则加剧，劳累即发；心主血脉，其华在面，血虚则面色白，唇甲不华；血不养心，心神不宁，故心悸少寐；气虚则神疲懒言，饮食减少；舌质淡，脉细弱均是气血两虚之象。故辩证为眩晕气血亏虚证，治宜补养气血，健运脾胃（E对）。健脾益气为脾气虚的治法，益肾温中为肾虚中阳不足的治法（A错）。温补脾肾为脾肾阳虚的治法，通络宁心为心阳不振,痰瘀阻络的治法（B错）。健脾益肾为脾肾两虚的治法，活血化瘀为血瘀的治法（C错）。补益肝肾为肝肾亏虚的治法，化瘀通络为瘀血阻络的治法（D错）。